女性，22岁。口服不详农药60ml后，呕吐，流涎，走路不稳，视物模糊，呼吸困难，口中有大蒜样气味。最重要的实验室检查是
A. 血液胆碱酯酶活力
B. 血电解质
C. 尿中磷分解产物检测
D. 肝、肾功能检查
E. 血气分析

正确答案：A。血液胆碱酯酶活力

解析：患者口服农药后口中有大蒜样气味为有机磷农药中毒的特征性表现，呕吐、流涎、视物模糊、呼吸困难为有机磷农药中毒后的典型毒蕈碱样症状，因此本例患者考虑为有机磷农药中毒。有机磷农药中毒的发生机制为其抑制体内胆碱酯酶活性导致乙酰胆碱堆积引起各种临床表现，因此血液胆碱酯酶活力（A对）测定是特异性实验指标。血电解质（B错）、肝肾功能（D错）、血气分析（E错）异常可见于多种疾病，不具有特异性。尿中磷分解产物检测（C错）有助于诊断有机磷中毒，但特异性不高。